有较强的肾毒性的是
A. 咖啡酸
B. 阿魏酸
C. 油酸
D. 乳酸
E. 马兜铃酸

正确答案：E。马兜铃酸

解析：本题考查的是芳香族有机酸。有较强的肾毒性的是马兜铃酸（E对）。芳香族有机酸：芳香酸在植物界中分布十分广泛，如羟基桂皮酸的衍生物普遍存在于中药中，尤以对羟基桂皮酸、咖啡酸（A错）、阿魏酸（B错）和芥子酸较为多见。但有少部分芳香族有机酸具有较强的毒性，如马兜铃酸等。据报道，马兜铃酸有较强的肾毒性，易导致肾功能衰竭。油酸（C错）属于有机酸，为鸦胆子的抗癌活性成分。乳酸（D错）属于有机酸，为丹参扩张冠状动脉的活性成分之一。